女，28岁。停经38天，阴道出血8天，伴下腹隐痛，检查：宫颈无举痛，宫体略大，质中，附件无明显肿块及压痛，hCG（+），要求人流。人流吸出物见到下列哪一项可排除宫外孕
A. 蜕膜组织
B. 绒毛
C. A-S反应
D. 增生期子宫内膜
E. 分泌期子宫内膜伴蜕膜反应

正确答案：B。绒毛

解析：将宫腔排出物或刮出物做病理检查，切片中见到绒毛，可诊断为宫内妊娠；仅见蜕膜未见绒毛，有助于诊断异位妊娠。掌握“异位妊娠”知识点。